有关NO₂的健康危害，错误的是
A. 主要作用于上呼吸道
B. 对眼睛的刺激作用较小
C. 毒性比NO高
D. 哮喘患者对NO₂较敏感
E. 与O₃有协同作用

正确答案：A。主要作用于上呼吸道

解析：本题考查NO₂的相关内容。NO₂较难溶于水，故对上呼吸道和眼睛的刺激作用较小（B对），主要作用于深部呼吸道、细支气管及肺泡（A错，为本题正确答案）。NO₂的毒性比NO高4～5倍（C对），大气NO₂污染对机体的呼吸系统可产生急性或慢性的不良影响。患有呼吸系统疾病如哮喘的人对NO₂比较敏感（D对）。有研究发现，在560μg/m³的NO₂中暴露30～110分钟，哮喘患者就可出现肺功能的改变。NO₂还与O₃具有协同作用（E对），造成呼吸道对感染的抵抗力降低。